白僵蚕具有的功效是
A. 收敛生肌
B. 明目祛翳
C. 化痰散结
D. 燥湿化痰
E. 消痰行水

正确答案：C。化痰散结

解析：白僵蚕的功效是息风止痉，祛风止痛，化痰散结（C对）。赤石脂的功效是涩肠止泻，敛疮止血，收敛生肌（A错）。炉甘石的功效是解毒明目祛翳（B错），收湿止痒，敛疮。半夏的功效是燥湿化痰（D错），降逆止呕，消痞散结；外用消肿止痛。旋覆花的功效是消痰行水（E错），降气止呕。